肺门结构不包括
A. 主支气管
B. 主支气管的分支
C. 支气管动脉
D. 支气管静脉
E. 肺淋巴管

正确答案：B。主支气管的分支

解析：主支气管是进入肺门后开始分叉，分支并不属于肺门的结构（B对）。